由于女性解剖结构和生理功能的特点：身高、体重和胸围均低于男性，肌力、心输出量和肺活量也比男性要小，因此妇女不宜从事的劳动是
A. 驾驶作业
B. 负重作业
C. 流水线作业
D. 缝纫作业
E. VDT作业

正确答案：B。负重作业